下列各项，不属系统性红斑狼疮临床表现的是
A. 80%患者出现对称性皮损
B. 患部对日光不敏感，春夏减轻
C. 发生在指甲周围皮肤及甲下者，可有出血性紫红色斑片
D. 严重者，可有全身泛发性多形性红斑
E. 手部遇冷可出现雷诺现象

正确答案：B。患部对日光不敏感，春夏减轻

解析：系统性红斑狼疮即系统性红蝴蝶疮，系统性红蝴蝶疮皮肤黏膜损害的表现为约80%的患者出现对称性的皮损典型者在两颊和鼻部出现蝶形红斑，为不规则形，色鲜红或紫红，边界清楚或模糊，有时可见鳞屑（A错）。患者对光敏感（B对）。皮损发生在指甲周围皮肤及甲下者，常为出血性紫红色斑片，高热时红肿光亮，时隐时现（C错）。皮损严重者，可有全身泛发性多形性红斑、紫红斑、水疱等（D错）。手部遇冷时有雷诺氏现象，常为本病的早期表现（E错）。